切面微红，有明显环纹的饮片是
A. 狗脊
B. 姜黄
C. 石菖蒲
D. 浙贝
E. 天麻

正确答案：C。石菖蒲

解析：本题考查的是石菖蒲饮片的性状鉴别。切面微红，有明显环纹的饮片是石菖蒲（C对）。石菖蒲：【性状鉴别】饮片呈扁圆形或长条形厚片。外表皮棕褐色或灰棕色，有的可见环节及根痕，切面纤维性，类白色或微红色，有明显环纹及油点。气芳香，味苦、微辛。狗脊（A错）：【性状鉴别】药材生狗脊片呈不规则长条形或圆形；切面浅棕色，较平滑，近边缘处有1条棕黄色隆起的木质部环纹或条纹，边缘不整齐。偶有金黄色绒毛残留；质脆，易折断，有粉性。饮片烫狗脊形如生狗脊片，表面略鼓起。棕褐色。气微，味淡、微涩。姜黄（B错）：【性状鉴别】饮片呈类圆形或不规则形厚片。外表皮深黄色，有时可见环节，切面棕黄色或金黄色，角质样，内皮层环纹明显，维管束点状散在。气香特异，味苦、辛。浙贝（D错）：【性状鉴别】饮片浙贝片为椭圆形或类圆形片，大小不一。外皮黄褐色或灰褐色，略皱缩；或淡黄白色，较光滑。切面微鼓起，灰白色；或平坦，粉白色。质脆，易折断，断面粉白色，富粉性。天麻（E错）：【性状鉴别】饮片呈不规则的薄片，外表皮淡黄色至淡黄棕色，有时可见点状排成的横环纹。切面黄白色或淡棕色，角质样，半透明。气微，味甘。